预防佝偻病的首选食品是
A. 瘦肉
B. 牛奶
C. 菠菜
D. 大米
E. 油菜

正确答案：B。牛奶